有头疽切开引流常作
A. 对口引流
B. —字形切口
C. 十字形切口
D. 梭形切口
E. S型切口

正确答案：C。十字形切口

解析：对口引流常用于乳痈（A错）。关节区脓肿常做一字形切口，S型切口（BE错）。有头疽查疮肿有明显波动感，可采用手术扩创排毒，作+或++字切开，务必脓泄畅达（C对）。梭形切口适用较广，非有头疽的适应切口（D错）。